含牙囊肿、萌出囊肿以及炎性牙旁囊肿上皮来源为
A. 牙板上皮剩余
B. 上皮根鞘
C. Malassez上皮剩余
D. 釉小皮
E. 缩余釉上皮

正确答案：E。缩余釉上皮

解析：缩余釉上皮发生的囊肿有含牙囊肿、萌出囊肿以及炎性牙旁囊肿。掌握“牙体、牙周组织的形成”知识点。